下面哪种氟化物不用于含氟牙膏
A. 氟化钙
B. 氟化钠
C. 氟化亚锡
D. 氟化胺
E. 单氟磷酸钠

正确答案：A。氟化钙

解析：本题考查含氟牙膏。氟化钙（A错，为本题的正确答案）中氟离子与钙离子结合失去活性，不能发挥防龋作用，因此氟化钙不用于含氟牙膏。含氟牙膏是指含有氟化物的牙膏，用于含氟牙膏的氟化物有氟化钠（B对）、单氟磷酸钠（E对）及氟化亚锡（C对）等。氟化钠是首先在牙膏中采用的一种“离子”型氟化物。氟化亚锡牙膏可以在防龋的同时提供抑菌和抗敏等多重作用。单氟磷酸钠是一种共价型氟化物牙膏，含单氟磷酸钠的浓度是0.76%。氟化胺（D对）有良好的防龋作用。